硫化氢引起缺氧的原因为
A. 机体的运氧功能障碍
B. 组织利用氧的功能障碍
C. 血液循环障碍
D. 肺通气功能和换气功能障碍
E. 引起呼吸肌麻痹

正确答案：B。组织利用氧的功能障碍